桑叶具有的功效是
A. 疏散风热，清利头目
B. 疏散风热，息风止痉
C. 疏散风热，解毒透疹
D. 疏散风热，平肝明目
E. 疏散风热，疏肝解郁

正确答案：D。疏散风热，平肝明目

解析：桑叶质轻疏散，苦多甘少，苦寒清泄，甘能益润。入肺经，能疏散风热、清润肺燥；入肝经，能清火益阴而明目，并兼凉血而止血，主治风热、燥热、血热所致诸疾。功效疏散风热，清肺润燥，平抑肝阳，清肝明目（D对）。疏散风热，清利头目（A错）是薄荷的功效。疏散风热，息风止痉（B错）是蝉蜕的功效。疏散风热，解毒透疹（C错）是牛蒡子的功效。疏散风热，疏肝解郁（E错）是柴胡的功效。